在防止食品腐败变质的措施中常采用低温保藏的方法，在低温条件下，食品最主要的变化是
A. 脂肪酸败
B. 蛋白质腐败变质
C. 碳水化合物分解
D. 水分流失
E. 维生素丢失

正确答案：A。脂肪酸败